男，35岁，4个月前从非洲旅行回国出现寒战、高热、大汗。当地医院考虑为疟疾。给予氯喹治疗后体温正常。之后再次去过流行区。1周前再次出现寒战、高热、大汗。应考虑为
A. 再燃
B. 疟原虫产生耐药
C. 再次感染疟原虫
D. 混合感染
E. 复发

正确答案：E。复发

解析：男性患者35岁，4个月前从非洲旅行回国后被诊断为疟疾，氯喹治疗后体温恢复正常。现又出现寒战、高热、大汗考虑为复发。复发是由寄生于肝细胞内的迟发型子孢子引起的，只见于间日疟和卵形疟。复发多见于病愈后的3～6个月（E对）。患者两次出现症状期间有体温正常期，可排除再燃的可能（A错）；患者第一次出现疟疾症状后给予氯喹治疗痊愈，再次前往流行区后出现症状，可排除疟原虫产生耐药的可能（B错）；患者第二次出现症状的原因是再次前往疟疾流行区，如果再次感染疟原虫，临床症状往往较轻，可排除再次感染疟原虫（C错）。